普通感冒患者应用抗病毒药+抗生素属于
A. 超剂量用药
B. 非适应证用药
C. 有目的联合用药
D. 超适应证用药
E. 过度治疗用药

正确答案：B。非适应证用药